如果癌细胞浸润范围较表浅仅限于基底膜下方时可称为
A. 高分化鳞癌
B. 中度分化鳞状细胞癌
C. 低分化鳞癌
D. 微浸润性鳞状细胞癌
E. 腺样囊腺癌

正确答案：D。微浸润性鳞状细胞癌

解析：如果鳞状癌细胞浸润范围较表浅仅限于基底膜下方时可称为微浸润性鳞状细胞癌。掌握“口腔黏膜鳞癌及疣状癌”知识点。